下列致病菌，对链霉素敏感的是
A. 鼠疫杆菌
B. 绿脓杆菌
C. 脑膜炎双球菌
D. 肺炎双球菌
E. 溶血性链球菌

正确答案：A。鼠疫杆菌

解析：链霉素属于氨基糖苷类抗生素，对土拉菌病和鼠疫杆菌（A对）有特效，特别是与四环素联合用药已经成为目前治疗鼠疫最有效的手段。链霉素对铜绿假单胞菌（B错）和其他革兰阴性杆菌活性最低。脑膜炎双球菌（C错）又名脑膜炎奈瑟菌或脑脊髓膜炎双球菌，属于革兰阴性球菌，对青霉素G比较敏感，但易产生耐药性，可用氯霉素进行治疗。肺炎双球菌（D错）为化脓性格兰阳性菌，可用青霉素G治疗，青霉素过敏者可选用红霉素，四环素等，也可用磺胺类抗生素。链霉素与青霉素可用于治疗溶血性链球菌（E错）及肠球菌等引起的心内膜炎。